应激时交感－肾上腺髓质系统兴奋，下列哪项既有防御意义又有不利意义的是
A. 心肌收缩力增强
B. 血糖增加
C. 心脑血流增加
D. 儿茶酚胺增多
E. 支气管扩张

正确答案：D。儿茶酚胺增多

解析：儿茶酚胺（D对）适度增多能通过对血液循环、呼吸和代谢等多个环节的紧急动员和综合调节，对机体有利的;当儿茶酚胺分泌过多时，会导致血液黏滞度升高，促进血栓形成，故儿茶酚胺增多是应激时交感－肾上腺髓质系统兴奋时既有防御意义又有不利意义的部分。